男，51岁，重症肺炎患者，入院后次日病情加重，突发持续性呼吸急促，发绀，伴烦躁，呼吸频率38次/分，心率108次/分，律齐，两肺可闻及湿啰音。血气分析：pH7.34，PaO₂50mmHg，PaCO₂30mmHg。胸片示两中下肺纹理增多模糊，斑片状阴影，心胸比例正常。最可能的诊断是
A. 肺梗死
B. 急性左心衰竭
C. 自发性气胸
D. 肺不张
E. 成人呼吸窘迫综合征（ARDS）

正确答案：E。成人呼吸窘迫综合征（ARDS）

解析：患者为中老年男性，患有重症肺炎（重症肺炎为急性呼吸窘迫综合征的危险因素），入院后次日病情加重，突发持续性呼吸急促，发绀，伴烦躁，呼吸频率38次/分，心率108次/分，律齐，两肺可闻及湿啰音，血气分析：pH7.34，PaO₂ 50mmHg（正常为＞60mmHg），PaCO₂30mmHg（正常为35-45mmHg）（符合ARDS的典型改变为PaO₂降低，PaCO₂降低），胸片示两中下肺纹理增多模糊，斑片状阴影，根据其临床表现和辅助检查，考虑诊断为成人呼吸窘迫综合征（ARDS）（E对）。肺梗死（P100）（A错）为肺动脉发生栓塞后，其支配区的肺组织因血流受阻或中断而发生坏死，其临床表现为呼吸困难、胸痛及咯血，X线胸片可显示：肺动脉阻塞征、肺动脉高压征及右心扩大征、肺组织继发改变，与患者临床表现以及X线表现不符，故不作为首选诊断。急性左心衰竭（P174-P175）（B错）表现为突发严重呼吸困难、咳粉红色泡沫样痰，胸部X线片显示：肺水肿时可看到蝶形肺门，严重肺水肿时，为弥漫满肺的大片阴影，与本例患者不相符。自发性气胸（P120）（C错）临床表现为突发胸痛，继之胸闷和呼吸困难，可伴有刺激性咳嗽，立位后前位X线胸片检查气胸的典型表现为外凸弧形的细线条阴影，线外透亮度增高，无肺纹理，线内为压缩的肺组织，与本例患者不符，故不作为首选诊断。肺不张（D错）可有胸闷、气急、呼吸困难、干咳等，胸部X线片可看到不张的肺组织透亮度降低，均匀性密度增高，与该患者表现不符。